有关糖皮质激素治疗溃疡性结肠炎的说法中，正确的是
A. 柳氮磺胺吡啶治疗无效时应用激素治疗效果亦差
B. 特别适合于重型活动性溃疡性结肠炎
C. 不可用于灌肠治疗
D. 不可与柳氮磺胺吡啶联合治疗
E. 可以作为试验性治疗用于溃疡性结肠炎的鉴别诊断

正确答案：B。特别适合于重型活动性溃疡性结肠炎

解析：糖皮质激素对溃疡性结肠炎急性发作期有较好疗效，特别适用于对5-ASA（5-氨基水杨酸）疗效不佳的重度患者（B对A错）。对于病变局限在直肠乙状结肠的患者，可用糖皮质激素作保留灌肠（C错）。病情缓解后糖皮质激素应逐渐减量，减量期间加用5-ASA逐渐接替激素治疗，故糖皮质激素可与柳氮磺胺吡啶联合治疗（D错）。糖皮质激素对溃疡性结肠炎、克罗恩病等疾病都有较好疗效，因此不能用于溃疡性结肠炎的鉴别诊断（E错）。